尖淋巴结
A. 沿颈内静脉排列
B. 沿颈外静脉排列
C. 其输出淋巴管形成颈干
D. 收纳肩胛上淋巴结
E. 收纳中央淋巴结

正确答案：E。收纳中央淋巴结

解析：尖淋巴结沿腋静脉排列（AB错），收集胸肌淋巴结、外侧淋巴结、肩胛下淋巴结（D错）、中央淋巴结（E对）和锁骨下淋巴结合成锁骨下干（C错）。